2岁儿童检查苯丙酮尿症应做
A. Guthri细菌生长抑制试验
B. 尿三氯化铁试验
C. 血清苯丙氨酸浓度测定
D. 尿甲苯胺蓝试验
E. 苯丙氨酸耐量试验

正确答案：C。血清苯丙氨酸浓度测定

解析：2岁儿童的苯丙氨酸代谢旁路已经建立，苯丙酮酸代谢物经尿排出，可以与三氯化铁反应呈绿色，因此尿三氯化铁用于较大儿童的苯丙酮尿症筛查（B错）。新生儿对苯丙氨酸代谢旁路尚未建立，尿三氯化铁试验为阴性，故采用 Guthrie细菌生长抑制试验（A错）进行筛查。血清苯丙氨酸浓度测定（C对）为确诊的检查方法。尿甲苯胺蓝试验（D错）主要用于黏多糖病的诊断。苯丙氨酸耐量试验（E错）用于检测某人是否是苯丙酮尿症致病基因携带者。